丹痧的典型舌象是
A. 镜面舌
B. 地图舌
C. 红绛舌
D. 草莓舌
E. 霉酱舌

正确答案：D。草莓舌

解析：丹痧，即猩红热，是由A组乙型溶血性链球菌感染后引起的急性发疹性呼吸道传染病，临床以发热、咽峡炎、全身弥漫性猩红色皮疹和疹退后皮肤脱屑为特征。其舌象表现为病初舌被白苔，红肿的乳头突出于白苔之外，称为白草莓舌；以后白苔脱落，露出鲜红舌面，舌乳头红肿明显并持续存在，称红草莓舌。另外，皮肤黏膜淋巴结综合征也可见草莓舌（D对）。镜面舌，舌深绛无苔而光亮如镜，主胃气、胃阴枯涸；舌色晄白如镜，毫无血色，也称白光白舌，主营血大亏，阳气将脱，均属病危难治（A错）。地图舌，属于剥苔范畴，一般主胃气不足，胃阴枯竭或气血两虚，亦是全身虚弱的一种征象(B错)。红绛舌，若苔质焦黄干燥，见于邪热深重，胃肠热结；若苔质黑而干燥，见于热极伤阴；若苔质为无苔见于热入血分，阴虚火旺（C错）。霉酱舌指舌苔厚腻垢浊不化，状如霉酱，伴便秘、腹胀者，为宿食内积，中焦气机阻滞（E错）。